男性，66岁。持续性呼吸困难10小时，3个月前曾发生股骨颈骨折。发现高血压病10年。体检：T36.5℃，BP90/60mmHg，颈静脉充盈，P₂亢进，心脏各瓣膜区未闻及杂音和心包摩擦音。心电图：电轴右偏，SⅠ、QⅢ、TⅢ。血清乳酸脱氢酶（LDH）增高，血清肌酸磷酸激酶同工酶（CK-MB）正常。该患者最可能的诊断是
A. 肺动脉栓塞
B. 急性心肌梗死
C. 急性心包炎
D. 主动脉夹层
E. 胸腔积液

正确答案：A。肺动脉栓塞

解析：患者为中老年男性，有股骨颈骨折病史（为肺血栓栓塞症的继发性危险因素），突发持续性呼吸困难10小时，心电图：电轴右偏，SⅠQⅢTⅢ，根据其临床表现和辅助检查，符合肺动脉栓塞（A对）的诊断。血清乳酸脱氢酶（LDH）的特异性及敏感性不如血清肌酸激酶同工酶（CK-MB），该患者CK-MB正常，故可以初步排除急性心力梗死（P239）（B错），并且心肌梗死最主要的临床表现为胸前区压榨性疼痛，程度重，持续时间长，心电图可呈现出特异性和动态性改变，该患者没有胸前区疼痛史，心电图仅表现为电轴右偏，SⅠQⅢTⅢ，故不考虑急性心肌梗死。急性心包炎（P302）（C错）主要表现为与呼吸运动相关的心前区疼痛，查体可有心包摩擦音，心电图示除aVR和V₁导联以外的所有常规导联可出现ST段呈弓背向下型抬高，aVR和V₁导联ST段压低，不符合该患者的表现及辅助检查。主动脉夹层（P324）（D错）主要表现为剧烈胸痛、高血压，但没有呼吸困难等症状。胸腔积液（P115）（E错）也表现为胸痛、呼吸困难，但无颈静脉充盈，P2亢进症状，心电图也无电轴右偏和SⅠQⅢTⅢ的改变。